平喘药有
A. 克仑特罗
B. 特布他林
C. 色甘酸钠
D. 地布酸钠
E. 酮替芬

正确答案：A、B、C、E。克仑特罗；特布他林；色甘酸钠；酮替芬